松果体属于
A. 下丘脑
B. 丘脑
C. 后丘脑
D. 上丘脑
E. 无

正确答案：D。上丘脑

解析：松果体属于上丘脑（D对），下丘脑（A对）主要核团有视交叉上核、室旁核、视上核 、漏斗核、背内侧核、腹内侧核、乳头体核和下丘脑后核等；丘脑（B错）分为三个核群：前核群、内侧核群和外侧核群；后丘脑（C错）分为内侧膝状体和外侧膝状体。